下列不属于卫生行政处罚的是
A. 没收非法财物
B. 管制
C. 暂扣或吊销有关许可证
D. 警告
E. 罚款

正确答案：B。管制

解析：根据《中华人民共和国行政处罚法》和我国现行卫生法律、法规和规章的规定，卫生行政处罚的种类主要有：警告（D对），罚款（E对），没收非法财物（A对），没收违法所得，责令停产停业，暂扣或吊销有关许可证等（C对）（B错，为本题正确答案）。